某老年人，77岁，患高血压高血脂，经常性便秘，日常膳食喜肉类食品，该老年人应该多进食的食物是
A. 瘦肉
B. 牛奶
C. 鸡蛋
D. 蔬菜、水果
E. 鱼类制品

正确答案：D。蔬菜、水果

解析：本题考查该老年人应该多进食的食物。本题中该老年人患高血压、高血脂，经常性便秘，日常膳食喜肉类食品，可知该老年人缺少维生素C的摄入，应该多进食一些新鲜蔬菜和水果（D对ABCE错）。